首先提出“合病与并病”之说的着作是
A. 《中藏经》
B. 《黄帝内经》
C. 《伤寒杂病论》
D. 《难经》
E. 《诸病源候论》

正确答案：C。《伤寒杂病论》

解析：合病与并病之说，首见于《伤寒论》（C对）；《伤寒杂病论》创立了辨证论治的诊治理论。《中藏经》发展了阴阳学说，将脏腑学说的理论系统化（A错）。《黄帝内经》奠定了中医学理论体系的基础（B错）。《难经》所述以基础理论为主，在《黄帝内经》的基础上，对脉学特别是“寸口脉诊”有较详细而系统的论述和创见，对藏象理论中命门、三焦以及经络理论有所阐扬和发展（D错）。《诸病源候论》为中医学第一部病因病机证候学专著（E错）。